精神障碍患者的病历资料保存期限为
A. 10年以上
B. 20年以上
C. 30年以上
D. 40年以上
E. 50年以上

正确答案：C。30年以上

解析：医疗机构及其医务人员应当在病历资料中如实记录精神障碍患者的病情、治疗措施、用药情况、实施约束、隔离措施等内容，并如实告知患者或者其监护人。患者及其监护人可以查阅、复制病历资料；但是，患者查阅、复制病历资料可能对其治疗产生不利影响的除外。病历资料保存期限不得少于30年。掌握“精神障碍概述、预防、诊断和治疗”知识点。